广藿香最善治
A. 胃热呕吐
B. 胃虚呕吐
C. 食积呕吐
D. 胃寒呕吐
E. 湿阻呕吐

正确答案：E。湿阻呕吐

解析：本题考查的是广藿香的主治病证。广藿香最善治湿阻呕吐（E对）。广藿香：【主治病证】（1）湿阻中焦证。（2）阴寒闭暑，暑湿证，湿温初起。（3）呕吐，尤宜湿浊中阻者。竹茹：【主治病证】（1）肺热咳嗽、咳痰黄稠。（2）痰火内扰之心烦失眠。（3）胃热呕吐（A错），妊娠恶阻。（4）胎热胎动。理中丸：【主治】脾胃虚寒，呕吐（B错）泄泻，胸满腹痛，消化不良。午时茶颗粒：【主治】外感风寒、内伤食积证，症见恶寒发热、头痛身楚、胸脘满闷、恶心呕吐（C错）、腹痛腹泻。白豆蔻：【主治病证】（1）湿阻中焦证。（2）脾胃气滞证。（3）胃寒呕吐（D错）。